急性胰腺炎的基本病理改变是
A. 纤维性变
B. 水肿、坏死
C. 假性囊肿
D. 脓肿
E. 萎缩、退化

正确答案：B。水肿、坏死